用阈下刺激即可诱发心肌细胞产生期前收缩的兴奋性周期时相是
A. 绝对不应期
B. 相对不应期
C. 低常期
D. 局部反应期
E. 超常期

正确答案：E。超常期

解析：由于离子通道基本复活而膜电位尚未完全恢复静息电位，给予阈下刺激即可诱发心肌细胞产生期前收缩的兴奋性周期时相即为超常期（E对）。绝对不应期（A错）是指兴奋发生过程中离子通道完全关闭，无论给予何种刺激，都不能诱发心肌细胞产生新的兴奋。相对不应期（B错）是指绝对不应期后，兴奋逐渐恢复，离子通道部分开放，需给予大于原来阈值的刺激强度才可以发生兴奋。低常期（C错）是指超常期后细胞出现的兴奋性轻度降低的时期，需要阈上刺激才可以引起再次兴奋。局部反应期（D错）是指阈下刺激不引起细胞或者组织产生动作电位，但它可以引起受刺激的膜局部出现一个较小的膜的去极化反应。